常用重结晶溶剂极性最大的是
A. 水
B. 甲醇
C. 丙酮
D. 四氯化碳
E. 石油醚

正确答案：A。水

解析：本题考查的是重结晶。常用重结晶溶剂极性最大的是水（A对）。重结晶法：从不纯的结晶经过进一步加溶剂结晶进行精制处理得到较纯结晶的过程称为重结晶。常用的重结晶溶剂有水、冰醋酸、甲醇、乙醇、丙酮、乙醚、三氯甲烷、苯、四氯化碳、石油醚和二硫化碳等。其中极性最大的溶剂为水。